菌斑控制良好的指标是
A. 有菌斑牙面数与总牙面数之比小于等于10％
B. 有菌斑牙面数与总牙面数之比小于等于15％
C. 有菌斑牙面数与总牙面数之比小于等于20％
D. 有菌斑牙面数与总牙面数之比小于等于25％
E. 有菌斑牙面数与总牙面数之比小于等于30％

正确答案：A。有菌斑牙面数与总牙面数之比小于等于10％

解析：本题考查菌斑控制良好的指标。菌斑是薄而无色的物质，黏附于牙面，菌斑控制是预防和治疗牙周病的必需措施，是牙周病基础治疗的重点。菌斑控制良好的指标是：有菌斑牙面数与总牙面数之比小于等于20％则属基本被控制，小于等于10%则控制良好（A对BCDE错）。